青蒿鳖甲汤主治
A. 骨蒸潮热
B. 夜热早凉
C. 日晡潮热
D. 身热夜甚
E. 皮肤蒸热

正确答案：B。夜热早凉

解析：青蒿鳖甲汤中鳖甲滋阴退热；青蒿苦辛而寒，两药共用，使阴分伏热有外达之机，生地甘凉，滋阴凉血，知母苦寒质润，丹皮泄血中伏火，整方滋阴清热，养阴而不恋邪，清热而不伤阴，用以治疗夜热早凉，热退无汗的阴虚发热之证（B对）。